输尿管第二个狭窄位于
A. 与髂血管交叉处
B. 与腹主动脉交叉处
C. 与输精管相交处（男性）
D. 斜穿膀胱壁处
E. 与子宫动脉交叉处（女性）

正确答案：A。与髂血管交叉处

解析：输尿管第二个狭窄位于与小骨盆上口与髂血管交叉处（A对）。